足三阴经在内踝上8寸以上的分布是
A. 太阴在前，厥阴在中，少阴在后
B. 厥阴在前，少阴在中，太阴在后
C. 少阴在前，太阴在中，厥阴在后
D. 厥阴在前，太阴在中，少阴在后
E. 太阴在前，少阴在中，厥阴在后

正确答案：A。太阴在前，厥阴在中，少阴在后

解析：该题考查足三阴经在小腿部的分布，注意十二经脉分布规律。手足阳经为阳明在前，少阳在中，太阳在后。手足阴经为太阴在前，厥阴在中，少阴在后（A对）。足三阴经在足内踝上8寸以下为厥阴在前，太阴在中，少阴在后（D错）。其它选项为明显错误没有如此分布的经脉（BCE错）。